男，73岁。急性肠梗阻术后5天，未进食但仍感腹胀，恶心未呕吐。有少量肛门排气。查体：腹部均匀隆起，腹软，叩诊呈鼓音，无压痛及反跳痛，肠鸣音减弱。首先采取的重要处理措施是
A. 查血生化并纠正水电解质紊乱
B. 胃肠减压
C. 急诊手术治疗
D. 局部封闭
E. 高渗盐水灌肠

正确答案：A。查血生化并纠正水电解质紊乱

解析：患者急性肠梗阻术后，有少量肛门排气，说明肠梗阻已经解除。有腹软、肠鸣音减弱，考虑为低血钾导致的肠蠕动减慢，应及早查血生化并纠正水、电解质紊乱（A对），无需急诊手术治疗（C错）。术后5天，恶心未呕吐无需胃肠减压（B错）。局部封闭主要用于缓解疼痛、控制炎症（D错）。高渗盐水灌肠可以促进肠梗阻术后胃肠功能恢复，但不是本例首要治疗（E错）。